女，10岁，晨起眼睑水肿加重3天，尿液浓茶色，半月前曾患猩红热，查体：P110次/分，BP135/90mmHg，眼睑水肿，肝肋下1cm，压痛（+），血肌酐400μmol/L。不适当药物处理措施
A. 氢氯噻嗪
B. 甘露醇
C. 青霉素
D. 呋塞米
E. 硝苯地平

正确答案：B。甘露醇

解析：患者女，10岁，晨起眼睑水肿加重3天，尿液浓茶色，半月前曾患猩红热（急性肾炎的诱因），查体：P110次/分，BP135/90mmHg，眼睑水肿，肝肋下1cm，压痛（+），血肌酐400μmol/L（急性肾炎的表现），结合患者的诱因和表现，提示为急性肾炎，应给予对症的利尿，降压，抗感染等治疗。甘露醇（渗透性利尿）可用于鉴别肾前性因素或急性肾功能衰竭引起的少尿，而不是急性肾炎的治疗方法（B错，为本题正确答案）。